既破血逐瘀，又续筋接骨的药是
A. 川芎
B. 三棱
C. 五灵脂
D. 穿山甲
E. 土鳖虫

正确答案：E。土鳖虫

解析：本题考查的是土鳖虫的功效。既破血逐瘀，又续筋接骨的药是土鳖虫（E对）。土鳖虫：【功效】破血逐瘀，续筋接骨。川芎（A错）：【功效】活血行气，祛风止痛。三棱（B错）：【功效】破血行气，消积止痛。五灵脂（C错）：【功效】活血止痛，化瘀止血，解蛇虫毒。穿山甲（D错）：【功效】活血消癥，通经下乳，消肿排脓。